与胃的血液供应无关的是
A. 肝固有动脉
B. 胃左动脉
C. 脾动脉
D. 胰十二指肠上动脉
E. 胃短动脉

正确答案：D。胰十二指肠上动脉

解析：胰十二指肠上动脉（D错，为本题正确答案）起自胃十二指肠动脉，分前后两支分布于胰头和十二指肠，与胃的血液供应无关。